玉屏风散除止汗外，还可
A. 清热解毒
B. 疏风散寒
C. 宣肺止咳
D. 解热止痛
E. 益气固表

正确答案：E。益气固表

解析：本题考查玉屏风散的功能。玉屏风散除止汗外，还可益气固表（E对）。玉屏风胶囊（颗粒、口服液）【功能】益气，固表，止汗。感冒退热颗粒【功能】疏风解表，清热解毒（A错）。感冒清热颗粒（口服液、胶囊）【功能】疏风散寒（B错），解表清热。桑菊感冒片（颗粒、丸、合剂）【功能】疏风清热，宣肺止咳（C错）。正柴胡饮颗粒【功能】发散风寒，解热止痛（D错）。